通过竞争醛固酮受体而发挥利尿作用的药物是
A. 氨苯蝶啶
B. 乙酰唑胺
C. 阿米洛利
D. 布美他尼
E. 螺内酯

正确答案：E。螺内酯

解析：本题考查螺内酯的作用机制。通过竞争醛固酮受体而发挥利尿作用的药物是螺内酯（E对）。螺内酯竞争抑制醛固酮受体，抑制K⁺-Na⁺交换，排钠保钾，发挥利尿作用。氨苯蝶啶（A错）属于保钾利尿剂，作用于远端小管和集合管，发挥利尿作用。乙酰唑胺（B错）是碳酸酐酶抑制药。阿米洛利（C错）是保钾利尿剂，作用于肾脏远端小管，阻断钠-钾交换机制。布美他尼（D错）作用于髓袢升支粗段，抑制Na⁺-K⁺-2Cl⁻同向转运。